功专健脾和胃的药是
A. 婴儿素
B. 导赤丸
C. 胃舒片
D. 启脾丸
E. 小儿健胃糖浆

正确答案：D。启脾丸